反复输血的个体进行实体器官移植时易发生的现象是
A. 异种移植排斥反应
B. 慢性排斥反应
C. 超急性排斥反应
D. 自体移植排斥
E. 急性排斥反应

正确答案：C。超急性排斥反应

解析：ABO血型不符或妊娠、输血和曾接受过器官移植而致敏，会导致超急性排斥反应（C对）。不同种之间的移植，如人与狒狒之间的移植，称异种移植（P160）（A错），移植后会引发强烈的排斥反应。慢性排斥反应（B错）主要为免疫因素如急性排斥反应反复发作，多种非免疫因素促进慢性排斥反应进展共同导致慢性移植物失功。自体移植排斥（P160）（D错）是供、受体为同一个体。急性排斥反应（E错）是临床最常见的一种排斥反应，细胞免疫反应和体液免疫反应均发挥重要作用。